卫生监督所对精炼食用植物油进行抽样检查，其中一份检测出酸价为5.2。该植物油
A. 不符合国家标准
B. 加醋后可食用
C. 可加热后食用
D. 可辐照后食用
E. 可食用

正确答案：A。不符合国家标准